上述各项，属虚证的是
A. 咽部溃烂，分散表浅
B. 咽部溃烂成片或凹陷
C. 咽部溃烂日久，周围苍白
D. 咽部溃烂，其上所覆白腐松厚
E. 咽部溃烂，其上所覆白腐坚韧

正确答案：C。咽部溃烂日久，周围苍白

解析：咽部溃烂日久，周围苍白属虚证（C对）。咽部溃烂，分散表浅属肺胃热轻浅，或虚火上炎（A错）。咽部溃烂成片或凹陷属肺胃热毒壅盛（B错）。D.咽部溃烂，其上所覆白腐松厚属伪膜轻证（D错）。咽部溃烂，其上所覆白腐坚韧属伪膜重证，多是白喉，又称“疫喉”（E错）。